颅内少突胶质细胞瘤患者最常见的首发症状是
A. 癫痫
B. 头痛
C. 脑积水
D. 恶心和呕吐
E. 视乳头水肿

正确答案：A。癫痫

解析：少突胶质细胞瘤起源于少突胶质细胞，好发于35~40岁，常见首发症状为局灶性癫痫(A对）｡